可判断有机磷杀虫药中毒的严重程度并指导治疗最有意义的是
A. 血胆碱酯酶活力
B. 血氧分压
C. 心率
D. 瞳孔大小
E. 肺部湿啰音

正确答案：A。血胆碱酯酶活力

解析：血胆碱酯酶（ChE）活力（A对）是诊断有机磷杀虫药中毒的特异性实验指标，对判断有机磷杀虫药中毒的严重程度并指导治疗最有意义。血氧分压（B错）、心率（C错）、瞳孔大小（D错）和肺部湿啰音（E错）等变化都是有机磷杀虫药中毒时的临床表现，并不具有诊断和指导意义。